舌下片剂的给药途径属于
A. 腔道给药
B. 黏膜给药
C. 注射给药
D. 皮肤给药
E. 呼吸道给药

正确答案：B。黏膜给药

解析：本题考查舌下片剂的给药途径。舌下片通过口腔黏膜吸收，为黏膜给药（B对）；腔道给药（A错）包括鼻腔、阴道给药等；注射给药（C错）包括皮下注射、肌肉注射、腹腔注射等；皮肤给药（D错）有凝胶、乳膏、涂剂和透皮贴片等；呼吸道给药（E错）有吸入用气雾剂及吸入粉雾剂等。